上颌神经依其行程可分为4段，其中不包括
A. 颅中窝段
B. 翼腭窝段
C. 眶下管段
D. 翼肌段
E. 面段

正确答案：D。翼肌段

解析：上颌神经依其行程可分为4段：颅中窝段、翼腭窝段、眶下管段、面段。掌握“三叉神经的分支与分布”知识点。